患者，女，66岁。头痛，耳鸣15天，伴头目胀痛，两侧为重，心烦易怒，夜寐不宁，口苦面红，伴有肢体麻木，舌红苔黄，脉弦，治疗应首选的方剂是
A. 芎芷石膏汤
B. 天麻钩藤饮
C. 银翘散
D. 龙胆泻肝汤
E. 镇肝熄风汤

正确答案：B。天麻钩藤饮

解析：患者“头痛，耳鸣15天”，辨为头痛病，头痛首辨外感、内伤。外感有风寒、风热、风湿；内伤者肝阳、血虚、气虚、肾虚、痰浊、瘀血。患者“头目胀痛，两侧为重，心烦易怒，夜寐不宁，口苦面红，伴有肢体麻木，舌红苔黄，脉弦”为肝阳上亢表现，为“肝阳头痛”，病机为肝失条达，气郁化火，阳亢风动，治宜平肝潜阳息风，方选天麻钩藤饮加减（B对）。